初入高原者的血气变化中，不会出现
A. 动脉血氧分压降低
B. 动脉血氧含量降低
C. 动-静脉氧含量差增大
D. 氧容量正常
E. 氧饱和度降低

正确答案：C。动-静脉氧含量差增大

解析：初入高原者，由于吸入氧分压降低，易引起乏氧性缺氧。其中动脉血氧分压降低（A对）、动脉血氧含量降低（B对）、动脉血氧容量正常或升高（D对）、动脉血氧饱和度降低（E对）、动-静脉血氧含量差正常或降低（C错，为本题正确答案）是乏氧性缺氧的血氧变化特点。